体质的可变性与什么相关
A. 先天禀赋
B. 思维变化
C. 后天因素
D. 阴虚体质
E. 阳虚体质

正确答案：C。后天因素

解析：体质具有稳定性和可变性，体质禀承先天，得养后天。先天禀赋决定着个体体质的相对稳定性和特异性；后天各种环境、营养、饮食、精神、疾病损害、年龄变化等使的体质具有可变性（C对）。